暂封窝洞时首选材料
A. 氧化锌丁香油水门汀
B. 磷酸锌水门汀
C. 氢氧化钙
D. 牙胶
E. 护洞漆

正确答案：A。氧化锌丁香油水门汀

解析：本题考查氧化锌丁香油水门汀的应用。氧化锌丁香油水门汀对牙髓刺激性小，并具有安抚、抗炎、抑菌作用，可用于窝洞的暂封（A对）。磷酸锌水门汀呈酸性会刺激牙髓（B错）。氢氧化钙易溶于唾液，不宜用于窝洞暂封（C错）。牙胶是常用的根管充填材料（D错）。护洞漆是涂在窝洞洞壁表面，以封闭牙本质小管，阻止细菌进入的窝洞封闭剂，由于封闭剂很薄，不能隔绝温度刺激，不能作为窝洞的暂封材料（E错）。